某男，72岁。口渴多饮、消瘦2年。曾住院治疗，诊断为2型糖尿病，长期服用西药降糖药。因症状控制不良，请中医诊治。现患者烦渴引饮，消谷善饥，小便频数而多，尿浊而黄。舌红苔薄黄少津，脉数。患者因求效心切，又考虑到中成药比中药汤剂服用方便，在继续服用西药降糖药的同时，自行服用中成药消糖灵胶囊，结果出现头晕、心悸、汗出等症状，急到医院就诊，诊断为低血糖反应。出现低血糖最可能的原因是
A. 所服消糖灵胶囊含有二甲双胍
B. 所服消糖灵胶囊含有格列吡嗪
C. 所服消糖灵胶囊含有阿卡波糖
D. 所服消糖灵胶囊含有格列齐特
E. 所服消糖灵胶囊含有格列本脲

正确答案：E。所服消糖灵胶囊含有格列本脲

解析：本题考查的是含西药组分的中成药。消渴患者在继续服用西药降糖药的同时，服用中成药消糖灵胶囊，结果出现头晕、心悸、汗出等症状，急到医院就诊，诊断为低血糖反应。出现低血糖最可能的原因是所服消糖灵胶囊含有格列本脲（E对）。消糖灵胶囊中含有西药成分格列本脲。格列本脲可促进胰岛B细胞分泌胰岛素，抑制肝糖原分解和糖原异生，增加胰外组织对胰岛素的敏感性和糖的利用，可降低空腹血糖与餐后血糖。其常用量一般为每次2.5mg，3次/日。磺胺过敏、白细胞减少者禁用，孕妇及哺乳期妇女不宜使用，肝肾功能不全、体虚高热、甲状腺功能亢进者慎用。服用过量易致低血糖。